流行性乙型脑炎的病变类型是属于
A. 渗出性炎
B. 变质性炎
C. 增生性炎
D. 出血性炎
E. 肉芽肿性炎

正确答案：B。变质性炎

解析：流行性乙型脑炎的主要病理变化为病变累及脑脊髓实质引起神经细胞变性、坏死，而实质细胞明显变性、坏死为变质性炎的特点，故流行性乙型脑炎属于变质性炎（B对）。增生性炎（C错）常见于伤寒（P358）等。渗出性炎（P74）（A错）可分为浆液性炎、纤维素性炎、化脓性炎和出血性炎，出血性炎（P76）（D错）常见于流行性出血热、钩端螺旋体病、鼠疫等。肉芽肿性炎（P78）（E错）属于慢性炎症，常见于结核病、梅毒、麻风等。